患儿，男，14岁。2周前患急性咽炎。1天前突然牙龈出血，口腔血疱，双下肢瘀斑。实验室检查：血红蛋白110g/L。白细胞9×10⁹/L，血小板10×10⁹/L，骨髓增生活跃，巨核细胞23%。应首先考虑的诊断是
A. 急性白血病
B. 再生障碍性贫血
C. 过敏性紫癜
D. 特发性血小板减少性紫癜（急性型）
E. 特发性血小板减少性紫癜（慢性型）

正确答案：D。特发性血小板减少性紫癜（急性型）

解析：特发性血小板减少性紫癜（D对）的临床表现有患者发病前1～2周有上呼吸道等感染史，特别是病毒感染史。起病急骤，部分患者可有畏寒、寒战、发热，皮肤、黏膜出血，内脏出血等，损伤及注射部位可渗血不止或形成大片瘀斑。急性白血病（A错）主要表现为贫血、出血、感染和浸润等征象；再生障碍性贫血（B错）的表现为严重贫血，感染和出血；过敏性紫癜（C错）可表现为皮肤紫癜，伴有皮肤水肿，荨麻疹；特发性血小板减少性紫癜（慢性型）（E错）主要见于成人，起病隐匿，出血多为皮肤、粘膜出血。